痛经气滞血瘀证的治法
A. 理气化瘀止痛
B. 温经暖宫止痛
C. 益气养血止痛
D. 清热除湿，化瘀止痛
E. 益肾养肝止痛

正确答案：A。理气化瘀止痛

解析：痛经气滞血瘀证的病机是肝失条达，冲任气血郁滞，经血不利，不通则痛；治宜理气活血，逐瘀止痛，方用活血祛瘀，行气止痛的膈下逐瘀汤（A对）。温经暖宫止痛（B错）为痛经寒湿凝滞证的治法；痛经气血虚弱证治宜益气养血止痛（C错）；痛经湿热瘀滞证治宜清热除湿，化瘀止痛（D错）；益肾养肝止痛（E错）为痛经肝肾亏损证的治法。